下列神经节中属于交感神经节的是
A. 三叉神经节
B. 下颌下神经节
C. 耳神经节
D. 翼腭神经节
E. 腹腔神经节

正确答案：E。腹腔神经节

解析：交感神经可分为椎前神经节和椎旁神经节，椎前神经节包括腹腔神经节（E对）,肠系膜上神经节、肠系膜下神经节及主动脉肾神经节等。